人体中最硬的组织是
A. 骨组织
B. 牙釉质
C. 牙本质
D. 牙骨质
E. 固有牙槽骨

正确答案：B。牙釉质

解析：釉质（牙釉质）是人体中最硬的组织。掌握“牙釉质”知识点。